氨基糖苷类抗生素的特点是
A. 快速杀菌对静止期细菌也有较强的作用
B. 无浓度依赖性
C. 无抗菌后效应
D. 碱性环境中抗菌活性减弱
E. 无初次接触效应

正确答案：A。快速杀菌对静止期细菌也有较强的作用

解析：本题考查氨基糖苷类抗生素的特点。氨基糖苷类药物通过抑制细菌蛋白质合成发挥作用，能够细胞膜，对静止期的细菌也有杀菌作用（A对）。氨基糖苷类药物为浓度依赖型（B错），具有抗菌后效应及初次接触效应（CE错），在碱性环境中抗菌作用增强（D错）。